从临床表现来看，感染型与毒素型食物中毒最大的区别在于
A. 有无恶心、呕吐
B. 有无腹痛、腹泻
C. 有无体温升高
D. 病死率不同
E. 死亡率不同

正确答案：C。有无体温升高